妊娠后应表现为
A. 子宫增大，质软
B. 子宫增大，质硬
C. 子宫增大，伴有进行性加重痛经
D. 子宫增大，伴有突然下腹部疼痛
E. 以上均不是

正确答案：A。子宫增大，质软

解析：子宫增大最初受内分泌激素水平影响，后期因宫腔内压力增加而逐渐增大。子宫增大主要是肌细胞肥大，为临产后子宫阵缩提供物质基础；由于怀孕之后体内的雌性激素大量增加，所以子宫局部变软（A对E错）；子宫增大，质硬可能是子宫出现炎症、囊肿、肿瘤等疾病（B错）；子宫增大，伴有进行性加重痛经可能为子宫腺肌症（C错）；子宫增大，伴有突然下腹部疼痛可能为子宫肌瘤，子宫腺肌症等疾病（D错）。